某地某年男性简略寿命表中0岁组的期望寿命是65.5岁。上述资料中，去除某死因后的期望寿命会
A. 等于65.5岁
B. 小于65.5岁
C. 大于65.5岁
D. 等于66.5岁
E. 不一定

正确答案：C。大于65.5岁

解析：本题考查期望寿命的影响因素。当消除了某种死因时，则原死于该死因的人不死于该死因，寿命就会有所延长。因此在本题中，去除某死因后的期望寿命会大于65.5岁（C对ABDE错）。